基因工程的第一步
A. 目的基因的分离
B. 载体的选择与准备
C. 目的DNA与载体连接
D. 重组DNA的导入
E. 重组体的筛选与鉴定

正确答案：A。目的基因的分离

解析：完整DNA克隆过程包括五大步骤：目的DNA的分离获取（分）（A对）；载体的选择与准备（选）（B错）；目的DNA与载体的连接（连）（C错）；重组DNA转入受体细胞（转）（D错）；重组体的筛选及鉴定（筛）（E错）。目的基因的分离获取是DNA克隆的第一步。